应用“多糖铁复合物胶囊”治疗缺铁性贫血，服药的注意事项包括
A. 可在餐时或餐后服用
B. 可用牛奶或咖啡送服
C. 不应与浓茶同服
D. 铁剂可能会引起粪便颜色变黑
E. 与维生素C同服可增加铁剂的吸收

正确答案：A、C、D、E。可在餐时或餐后服用；不应与浓茶同服；铁剂可能会引起粪便颜色变黑；与维生素C同服可增加铁剂的吸收

解析：本题考查口服铁剂。口服型铁剂有轻度胃肠道反应，宜在餐后或餐时服用，以减轻胃部刺激（A对）。铁剂可引起便秘，并排黑便（D对）。维生素C与铁剂同服，铁剂吸收增加（E对）。铁剂不应与浓茶同服（C对），也不能用牛奶或咖啡送服（B错），会影响铁剂的吸收。